下列关于髓腔增龄变化的叙述中，不恰当的说法是
A. 乳牙的髓腔髓角高，根尖孔也大
B. 青少年恒牙的髓腔比老年者大
C. 老年人的髓腔根管粗、根尖孔大
D. 青少年恒牙的髓腔髓室大、髓角高
E. 老年人的髓腔随着年龄的增长体积逐渐缩小

正确答案：C。老年人的髓腔根管粗、根尖孔大

解析：乳牙的髓腔从相对比例看比恒牙者大，髓角高，根尖孔也大些。青少年恒牙的髓腔比老年者大，表现为髓室大、髓角高、根管粗、根尖孔亦大。老年人随着年龄的增长，在髓腔内壁有继发性牙本质向心性沉积，使髓腔的体积逐渐缩小，髓角变低平，根管变细，根尖孔窄小，有的髓腔部分或全部钙化阻塞，给临床治疗带来困难。掌握“髓腔各部分名称、增龄性变化及临床意义”知识点。